身长约为出生时1.5倍的年龄是
A. 3月龄
B. 6月龄
C. 8月龄
D. 10月龄
E. 12月龄

正确答案：E。12月龄

解析：本题考查身材的增长。儿童身长增长随年龄增加逐渐减缓，出生时身长平均为50cm，3月龄时身长61～63cm, 增长约ll～13cm；1岁时（E对ABCD错）约为出生时身长的1.5倍，即75～77cm。出生后第一年身长增加约25～27cm, 是生后增长最快的时期，为第一生长高峰。